通过描述疾病年龄分布探讨病因，最好的方法是
A. 出生队列分析
B. 横断面分析
C. 发病率分析
D. 死亡率分析
E. 队列分析

正确答案：A。出生队列分析